关于腹膜的解剖生理，错误的是
A. 成人腹膜总面积可达2m²
B. 正常腹腔可有100ml液体
C. 腹膜有强大吸收力
D. 腹膜可分泌大量渗出液
E. 脏层腹膜比壁层腹膜痛觉敏感

正确答案：E。脏层腹膜比壁层腹膜痛觉敏感

解析：识记内容。腹膜分为壁腹膜和脏腹膜两部分。壁腹膜贴附于腹壁、横膈脏面和盆壁的内面；脏腹膜覆盖于内脏表面。脏腹膜受自主神经支配，对牵拉、化学等刺激较为敏感，常为钝痛且定位不准确，壁腹膜主要受体神经支配，对各种刺激敏感，痛觉定位准确，因此壁层腹膜比脏层腹膜敏感（E错，为本题正确答案）。腹膜有很多皱襞，其面积几乎与全身的皮肤面积相等，成人腹膜总面积可达2m²（A对）。脏、壁层腹膜之间潜在的腔隙称为腹膜腔，腹膜腔是人体最大的体腔，可分为大、小腹腔两部分，即腹腔和网膜囊。正常情况下，腹腔内有75～100ml（B对）液体，起润滑作用。腹膜有强大的吸收能力（C对），可吸收腹腔内的积液、空气和毒素等。在急性炎症时，腹膜可分泌大量渗出液（D对），以稀释毒素和减轻刺激。